筛查受试物的潜在致癌作用和细胞致突变性的试验是
A. 急性经口毒性试验
B. 遗传毒性试验
C. 90天经口毒性试验
D. 致畸试验
E. 慢性毒性试验

正确答案：B。遗传毒性试验

解析：本题考查筛查受试物的潜在致癌作用和细胞致突变性的试验。遗传毒性试验（B对ACDE错）的目的是了解受试物的遗传毒性以及筛查受试物的潜在致癌作用和细胞致突变性。